医学模式转变在医学伦理方面的重要性是指
A. 促进了医学思维方式的变革
B. 提高了社会防止疾病的地位
C. 实现了在更高层次上对人的健康的全面关怀
D. 加速了祖国医学的整理和提高
E. 促进了医师知识结构的现代化

正确答案：C。实现了在更高层次上对人的健康的全面关怀

解析：本题考查医学模式转变在医学伦理方面的重要性。医学模式转变在医学伦理方面的重要性是指实现了在更高层次上对人的健康的全面关怀（C对）。医学模式是人们关于健康和疾病的基本观点，是医学临床和医学科研的指导思想、理论框架和行为范式。医学模式来源于医学实践，是对医学实践的反映和概括。迄今为止，出现过三种医学模式，即：古代朴素的整体医学模式、近代生物医学模式和现代生物-心理-社会医学模式。生物-心理-社会医学模式是20世纪70年代以后建立起来的一种全新的医学模式。这种医学模式，从生物、心理、社会等综合因素全面认识健康和疾病。生物-心理-社会医学模式取代生物医学模式，不仅反映着医学的发展，而且呼唤着医德的进步。生物-心理-社会医学模式对医德提出了更高的要求。不仅要关心病人的躯体，而且要关心病人的心理；不仅要关心病人的个体，而且要关心病人的家属、后代及整个社会；不仅要解决医德情感问题，更要解决医德理论和医德智慧问题。